控释小丸或膜控型片剂的包衣中加入PEG的目的是
A. 助悬剂
B. 增塑剂
C. 成膜剂
D. 乳化剂
E. 致孔剂

正确答案：E。致孔剂